关于外用制剂临床适应证的说法，错误的是
A. 冻疮软膏适用于中度破溃的冻疮、手足皲裂的治疗
B. 水杨酸乳膏忌用于糜烂或继发性感染部位的治疗
C. 氧化锌糊剂适用于有少量渗出液的亚急性皮炎、湿疹的治疗
D. 吲哚美辛软膏适用于风湿性关节炎、类风湿性关节炎的治疗
E. 地塞米松涂剂适用于神经性皮炎、慢性湿疹、扁平苔藓的治疗

正确答案：A。冻疮软膏适用于中度破溃的冻疮、手足皲裂的治疗

解析：本题考查外用制剂临床适应证。冻疮软膏用于轻度未破溃的冻疮、手足皲裂（A错，为本题正确答案）；水杨酸乳膏用于治疗手、足癣及体、股癣，忌用于糜烂或继发性感染部位的治疗（B对）；氧化锌糊剂适用于有少量渗出液的亚急性皮炎、湿疹的治疗（C对）；吲哚美辛软膏适用于风湿性关节炎、类风湿性关节炎的治疗（D对）；地塞米松涂剂适用于神经性皮炎、慢性湿疹、扁平苔藓的治疗（E对）。